头部位置觉感受器位于
A. 椭圆囊斑、球囊斑与壶腹嵴
B. 耳蜗
C. 前庭窗
D. 螺旋器
E. 以上均不对

正确答案：A。椭圆囊斑、球囊斑与壶腹嵴

解析：椭圆囊斑、球囊斑与壶腹嵴均（A对）属位觉感受器。螺旋器（D错）是听觉感受器。